成釉器中对内釉上皮有营养作用和缓冲作用，并能保护成釉器的细胞层是
A. 外釉上皮
B. 内釉上皮
C. 星网状层
D. 中间层
E. 成牙本质细胞层

正确答案：C。星网状层

解析：本题考查牙胚的发生及分化。成釉器帽状期出现星网状层（C对），此层细胞间充满富有蛋白的黏液样液体，对内釉上皮有营养和缓冲的作用，以保护成釉器。